羌活胜湿汤与独活寄生汤共同功效
A. 祛风湿止泻
B. 祛风湿止痛
C. 袪风胜湿淸热
D. 祛风胜湿化痰
E. 祛风湿，补肝肾

正确答案：B。祛风湿止痛

解析：羌活胜湿汤的功用祛风，胜湿，止痛；独活寄生汤的功用祛风湿，止痹痛，益肝肾，补气血。两方均有独活，独活的功效是祛风胜湿，散寒止痛。羌活胜湿汤与独活寄生汤均可祛风湿止痛（B对）。